锁骨骨折多在
A. 锁骨内侧1/3于外侧2/3交界处
B. 锁骨中段
C. 锁骨内侧2/3与外侧1/3交界处
D. 肩峰端
E. 胸骨端

正确答案：C。锁骨内侧2/3与外侧1/3交界处

解析：锁骨骨折多在锁骨内侧2/3与外侧1/3交界处（C对）。